正确诊断的第一步是
A. CT检查
B. 心电图检查
C. 体格检查
D. 问诊
E. 实验室检查

正确答案：D。问诊

解析：正确诊断的第一步是问诊，诊断疾病最基本的方法，选择其他检查手段的依据，建立良好医患关系的时机（D对）。CT检查、心电图检查属于辅助检查，在疾病做出初步诊断后通过辅助检查来明确诊断（AB错）。通过体格检查可搜集资料、认识疾病（C错）。实验室检查可进一步明确诊断（E错）。